调查需要的工作量大，成本太高，所以只能在较小范围内使用属于下列哪种调查方法的最大缺点
A. 抽样调查
B. 群组研究
C. 捷径调查
D. 病例-对照研究
E. 普查

正确答案：E。普查

解析：普查的最大缺点是这种调查需要的工作量大，成本太高，所以只能在较小范围内使用，如计划在一所或几所学校或某个社区开展的口腔保健活动，在此之前可使用普查以准确获得疾病的基线资料。掌握“口腔健康状况调查的目的、项目、标准及方法”知识点。